具有养心安神功效的药物是
A. 朱砂
B. 磁石
C. 二者均是
D. 二者均不是

正确答案：D。二者均不是

解析：本题考查的是朱砂与磁石的功效。朱砂与磁石均不具有养心安神功效（D对）。朱砂（A错）：【功效】镇心安神，清热解毒。磁石（B错）：【功效】镇惊安神，平肝潜阳，聪耳明目，纳气平喘。养心安神为酸枣仁的功效。酸枣仁：【功效】养心安神，敛汗。